早期流产最常见原因
A. 染色体异常
B. 细菌感染
C. 胚胎发育异常
D. 胎盘功能不全
E. 宫颈内口松弛

正确答案：A。染色体异常

解析：早期流产最常见原因染色体异常（A对），约占50%-60%，细菌感染（B错）、胚胎发育异常（C错）、胎盘功能不全（D错）、宫颈内口松弛（E错）虽然也可以导致早期流产，但不是最常见的原因。